在中国药典中，肾上腺素的含量测定方法是
A. 重量法
B. 铈量法
C. 银量法
D. 亚硝酸钠滴定法
E. 非水溶液滴定法

正确答案：E。非水溶液滴定法

解析：本题考查非水溶液滴定法。在中国药典中，肾上腺素的含量测定方法是非水溶液滴定法（E对）。非水溶液滴定法分为非水碱量法和非水酸量法，非水碱量法用于测定有机弱碱及其盐类药物，如肾上腺素。铈量法（B错）属于氧化还原滴定法。亚硝酸钠滴定法（D错）：亚硝酸钠在盐酸存在条件下与具有芳伯氨基化合物发生重氮化反应，定量生成重氮盐，根据亚硝酸钠的消耗量可计算出药物有效成分的含量。重量法（A错）是先分离再称量。用称量的方法测定含量。银量法（C错）是测定能与Ag⁺反应生成难溶性沉淀的一种容量分析法，用于苯巴比妥等药物的含量测定。